未经磨耗的年轻恒磨牙，（牙合）面沟嵴清晰，备洞时不易确定洞型的边缘，此时的龋病治疗，最理想的方法是
A. 银汞充填+窝沟封闭
B. 复合树脂充填+窝沟封闭
C. 再矿化治疗+窝沟封闭
D. 再矿化治疗+银汞充填
E. 再矿化治疗+复合树脂充填

正确答案：B。复合树脂充填+窝沟封闭

解析：本题考查龋病的治疗。复合树脂充填（B对）对洞型要求不如银汞充填严格，主要靠粘接固位，可以采用；年轻恒（牙合）面点隙窝沟较深，极易发生龋坏，窝沟封闭可作为预防点隙窝沟龋发生的手段。年轻恒牙髓腔整体宽大，髓角高，而银汞充填（A错）时要求制备一定的盒状洞型，备洞时易穿髓。再矿化治疗（CDE错）适用于光滑面早期龋，白垩斑或褐斑。